偏头痛的预防性治疗药物是
A. 咖啡因麦角胺
B. 英明格
C. 苯噻啶
D. 小剂量阿司匹林
E. 消炎药

正确答案：C。苯噻啶

解析：偏头痛的预防用药包括：肾上腺素能受体阻滞剂，钙离子拮抗剂，抗癫痫药，抗抑郁药，5-HT受体拮抗剂。苯噻啶（C对）属于5-HT受体拮抗剂，可作为偏头痛的预防用药。咖啡因麦角胺（特异性止痛药）（A错）、英明格（B错）、小剂量阿司匹林（非特异性止痛药）（D错）和消炎药（E错）等为偏头痛发作期的治疗用药（P162）。